天门冬氨酸氨基转移酶（AST）的正常参考值为
A. ＜10U/L
B. ＜20U/L
C. ＜30U/L
D. ＜40U/L
E. ＜50U/L

正确答案：D。＜40U/L

解析：天门冬氨酸氨基转移酶（AST）的正常参考值为8～40U/L，即＜40U/L（D对）。急、慢性病毒性肝炎患者天门冬氨酸氨基转移酶（AST）可升高。